女，25岁。右鼻翼皮肤红肿、疼痛5天，中心有脓头，自行挑破、挤压、排脓。1天后局部肿胀加重伴寒战、高热、头痛，逐渐神志不清。查体：T39°C，P90次/分，BP100/60mmHg。最可能的诊断是
A. 化脓性海绵状静脉窦炎
B. 面部蜂窝织炎
C. 眼眶内化脓性炎症
D. 菌血症
E. 面部痈

正确答案：A。化脓性海绵状静脉窦炎

解析：患者鼻翼（危险区）有疖痈，自行挑破、挤压、排脓后（处理不当，病菌可经内眦静脉、眼静脉进入颅内海绵状静脉窦）局部肿胀加重伴寒战、高热、头痛，逐渐神志不清（化脓性海绵状静脉窦炎的表现），因此最可能的诊断是化脓性海绵状静脉窦炎（A对）。